影响人类行为的主要因素不包括
A. 环境因素
B. 个人因素
C. 相邻因素
D. 认知因素
E. 社会态度

正确答案：C。相邻因素